可以代替大环内酯类用于支原体肺炎的药物是
A. 磺胺嘧啶
B. 甲硝唑
C. 甲氧苄啶
D. 诺氟沙星
E. 甲磺灭脓

正确答案：D。诺氟沙星

解析：氟喹诺酮类可代替大环内酯类治疗嗜肺军团菌、肺炎支原体和衣原体的感染，诺氟沙星第十版药理学（氟哌酸）为第一个氟喹诺酮类药物（D对）。